女，35岁。腹胀、腹部隐痛伴低热3个月。突发脐周绞痛6小时，呕吐数次，无排气，排便。最可能的诊断是
A. 消化性溃疡并幽门梗阻
B. 慢性阑尾炎急性发作
C. 结肠癌并肠穿孔
D. 结核性腹膜炎并肠梗阻
E. 缺血性肠病并肠梗阻

正确答案：D。结核性腹膜炎并肠梗阻

解析：青年女性患者，腹痛、腹胀伴低热3个月，突发脐周绞痛、呕吐，无排便、排气（提示急性肠梗阻），最可能的诊断为结核性腹膜炎并肠梗阻（D对）。结核性腹膜炎多继发于肺结核，常见于中青年，主要表现为腹部隐痛、腹胀、腹部包块及低热、盗汗等结核中毒症状，肠梗阻为其常见并发症。消化性溃疡（A错）主要表现为周期性、节律性的上腹痛，疼痛多与进食相关，可被抑酸或抗酸剂缓解，并发幽门梗阻后可出现反复呕吐，呕吐物为含有酸臭味的宿食，不含胆汁，无停止自肛门排气排便等表现。慢性阑尾炎（P377）（B错）大多由急性阑尾炎转变而来，症状不典型，常有右下腹疼痛，有位置较为固定的局限性压痛，其急性发作症状与急性阑尾炎相同。结肠癌（C错）多见于中老年人，早期无特异性症状，多有排便习惯与粪便性状改变、腹痛、腹部肿块、全身症状（如发热、贫血）等，伴发肠穿孔后可出现腹膜刺激症状。缺血性肠病（P365）（E错）发病多较急骤，早期表现为突发的剧烈腹部绞痛，恶心、呕吐频繁，呕吐物多为血性，腹部体征较轻微，与严重的症状不相称。